麦冬的功效是
A. 益胃生津
B. 补肝明目
C. 补阴益气
D. 壮阳健骨
E. 软坚散结

正确答案：A。益胃生津

解析：本题考查的是麦冬的功效。麦冬的功效是益胃生津（A对）。麦冬：【功效】润肺养阴，益胃生津，清心除烦，润肠通便。枸杞子：【功效】滋补肝肾，明目（B错），润肺。黄精：【功效】滋阴润肺，补脾益气（C错）。仙茅：【功效】补肾壮阳，强筋健骨（D错），祛寒除湿。鳖甲：【功效】滋阴潜阳，退热除蒸，软坚散结（E错）。